麻仁胶囊的主治病证是
A. 肠热津亏所致的便秘
B. 气虚肠燥所致的便秘
C. 水停气滞所致的水肿、便秘
D. 肠胃实热积滞所致的便秘
E. 肝胆火旺所致的便秘

正确答案：A。肠热津亏所致的便秘

解析：本题考查的是麻仁胶囊的主治。麻仁胶囊的主治病证是肠热津亏所致的便秘（A对）。麻仁胶囊：【主治】肠热津亏所致的便秘，症见大便干结难下、腹部胀满不舒；习惯性便秘见上述证候者。舟车丸：【主治】水停气滞所致的水肿，症见蓄水腹胀、四肢浮肿、胸腹胀满、停饮喘急、大便秘结（C错）、小便短少。通便宁片：【主治】肠胃实热积滞所致的便秘（D错），症见大便秘结、腹痛拒按、腹胀纳呆、口干苦、小便短赤、舌红苔黄、脉弦滑数。当归龙荟丸：【主治】肝胆火旺所致的心烦不宁、头晕目眩、耳鸣耳聋、胁肋疼痛、脘腹胀痛、大便秘结（E错）。气虚肠燥所致的便秘（B错），2022年考试指南未明确说明。